下列不是口腔癌警告标志的是
A. 2周以上尚未愈合的口腔溃疡
B. 口腔黏膜有白色、红色和发暗的斑
C. 口腔与颈部有不正常的肿胀和淋巴结肿大
D. 口腔反复出血，出血原因不明
E. 第三磨牙周围反反复复的炎症

正确答案：E。第三磨牙周围反反复复的炎症

解析：口腔癌警告标志：①口腔内的溃疡，2周以上尚未愈合；②口腔黏膜有白色、红色和发暗的斑；③口腔与颈部有不正常的肿胀和淋巴结肿大；④口腔反复出血，出血原因不明；⑤面部、口腔、咽部和颈部有不明原因的麻木与疼痛。掌握“口腔癌的预防”知识点。